奇经八脉中与脑、髓、肾关系密切的是
A. 冲脉
B. 督脉
C. 阴跷脉
D. 阳维脉
E. 阴维脉

正确答案：B。督脉

解析：督脉起于胞中，下出会阴，故与肾有关；督脉沿脊柱里面上行，至项后风府穴进入颅内，络脑，故与髓，脑有密切关系（B对）。冲脉（A错）调节十二经气血，主生殖功能。阴跷脉（C错），可控制眼睑开合，和主下肢运动。阳维脉（D错）主要作用是维络诸阳。阴维脉（E错）主要作用是维络诸阴。